某男性患者，37岁，体检查出空腹血糖9.79mmol/L，尿糖（++），本人无明显不适。入院复查餐后血糖、糖化血红蛋白，医师诊断为2型糖尿病，并给予磺酰脲类降糖药。磺酰脲类降糖药的作用机制是
A. 加速胰岛素合成
B. 抑制糖原分解
C. 刺激胰岛B细胞释放胰岛素
D. 抑制葡萄糖吸收
E. 提高葡萄糖的转运能力

正确答案：C。刺激胰岛B细胞释放胰岛素

解析：本题考查磺酰脲类降糖药的作用机制。某男性患者，37岁，体检查出空腹血糖9.79mmol/L（正常值为＜6.1mmol/L），尿糖（++）（正常为尿糖阴性），本人无明显不适。入院复查餐后血糖、糖化血红蛋白，医师诊断为2型糖尿病，并给予磺酰脲类降糖药。磺酰脲类降糖药的作用机制是刺激胰岛B细胞释放胰岛素（B对AE错）。抑制糖原分解（B错）可见于双胍类药物。抑制葡萄糖吸收（D错）可见于α-葡萄糖苷酶。